中药归经配伍可以使药效更加集中于某一经络、某一脏腑上，从而提高临床疗效可作为手少阴引经药的是
A. 细辛
B. 独活
C. 升麻
D. 川芎
E. 藁本

正确答案：A。细辛

解析：本题考查的是中药配伍原则。中药归经配伍可以使药效更加集中于某一经络、某一脏腑上，从而提高临床疗效可作为手少阴引经药的是细辛（A对）。中药归经配伍：从气味厚薄，升降浮沉，进行比较分析，更能构成对于药物功用的比较全面的认识，可以从此选出最适合于当前病情需要的药物。再运用引经报使的方法，使药效更加集中于某一经络、某一脏腑、某一病情上，从而提高疗效。但归经、引经的理论，亦存在一些问题，最主要的是不可能概括所有的药物，亦包含着某些推测的成分。但便于学，便于用，是属于执简驭繁的药物优选方法，是无可非议的。以下选择几味，作为举例（援《本草纲目》“引经报使”的二十余种药），引申其义。如细辛气味辛温，无毒，入足少阴、厥阴经血分，又为手少阴引经之药，并能治督脉为病；藁本（E错）气味辛温，无毒，足太阳本经药，亦治督脉为病；黄柏气味苦寒，无毒，入足少阴经，为足太阳引经药；独活（B错）气味辛苦微温，无毒，入足少阴经气分；升麻（C错）气味甘苦平微寒，无毒，为足阳明、足太阴引经药，亦入手阳明、手太阴经，并治带脉为病；川芎（D错）气味辛温，无毒，少阳本经引经药，入手、足厥阴气分等。